白芍不具有的功效是
A. 养血调经
B. 柔肝止痛
C. 养心安神
D. 平仰肝阳
E. 敛阴止汗

正确答案：C。养心安神

解析：本题考查的是白芍的功效。白芍不具有的功效是养心安神（C错，为本题正确答案）。白芍：【功效】养血调经（A对），敛阴止汗（E对），柔肝止痛（B对），平抑肝阳（D对）。养心安神为刺五加的功效。刺五加：【功效】补气健脾，益肾强腰，养心安神，活血通络。